某男性，25岁，BMI为29，日常膳食应选用
A. 低嘌呤膳食
B. 高GI膳食
C. 低蛋白膳食
D. 高蛋白、低脂肪、低碳水化合物膳食
E. 少渣膳食

正确答案：D。高蛋白、低脂肪、低碳水化合物膳食

解析：本题考查该男性应选用的日常膳食。本题中该男性BMI为29≥28为肥胖，日常膳食应选用高蛋白（供能比占20%～25%），低脂肪（供能比占20%～30%）、低碳水化合物（供能比占45%～50%）膳食（D对ABCE错）。